男，55岁。右上腹疼痛3个月。呈持续性钝痛，向右肩背部放射，伴乏力，发病以来体重减轻6kg。查体：T36.5℃，P80次/分，R18次/分，BP120/80mmHg，巩膜无黄染，双肺呼吸音清，未闻及干湿性啰音，心律齐，肝肋下3cm，质地稍硬，有结节感。实验室检查AFP800μg/L，CEA正常。腹部B超：肝右叶8cm×6cm占位性病变，向外生长，周边血流量增强；门静脉正常。最理想的治疗方法是
A. 肿瘤切除加放疗
B. 姑息性肝切除术
C. 根治性肝切除术
D. 局部射频治疗
E. 经肝动脉化疗栓塞

正确答案：C。根治性肝切除术

解析：中年男性患者，右上腹疼痛3个月。呈持续性钝痛，向右肩背部放射，伴乏力，发病以来体重减轻6kg。查体：T36.5℃（腋温正常值为36～37℃），P80次/分（正常值为（60～100）次/分），R18次/分（正常值为（12～20）次/分），BP120/80mmHg（正常值为﹤90～120/60～80mmHg），巩膜无黄染，双肺呼吸音清，未闻及干湿性啰音，心律齐，肝肋下3cm（肝脏肿大），质地稍硬，有结节感。B超示肝右叶肿块，AFP800μg/L（AFP﹥400μg/L考虑肝癌），结合患者病史、体查及影像学检查，可考虑诊断为肝癌。患者癌肿局限在肝右叶，向外生长，门静脉正常（无癌栓形成），最理想的治疗方法是根治性肝切除术（C对）。肿瘤切除加放疗（A错）临床效果不如根治性肝切除术，且在临床肝癌治疗中应用较少。姑息性肝切除术（B错）适用于不能做根治性肝切除术的患者。局部射频治疗（D错）适用于不宜手术或不需要手术治疗的肝癌。经肝动脉化疗栓塞（E错）主要用于不可切除的肝癌或切除后的辅助性治疗。